可用于描述两连续型变量之间相关关系的统计图是
A. 散点图
B. 圆图
C. 直条图
D. 直方图
E. 线图

正确答案：A。散点图

解析：可用于描述两连续型变量之间相关关系的统计图是散点图（A对），即用点的密度和变化趋势表示两指标之间的直线和曲线关系。圆图（B错）中把圆的总面积作为100%，表示事物的全部，而圆内各扇形面积用来表示全体中各部分所占的比例。直条图（C错）又称条图，用等宽直条的长短来表示相互独立的统计指标数值大小和它们之间的对比关系。直方图（D错）用直条矩形面积代表各组频数，各矩形面积总和代表频数的总和，它主要用于表示连续变量频数分布情况。线图（E错）是用线段的升降来表示指标（变量）的连续变化情况，适用于描述一个变量随另一个变量变化趋势。